下列哪项不是引起不寐的原因
A. 胃中不和，痰热内扰
B. 思虑劳倦，内伤心脾
C. 心虚胆怯，心神不安
D. 阴虚火旺，肝阳扰动
E. 气郁痰结，阻闭神明

正确答案：E。气郁痰结，阻闭神明

解析：脾胃受损，痰热上扰，导致胃气失和，不得安寐（A对）。思虑太过，损伤心脾，神不守舍（B对）。或由暴受惊恐，导致心虚胆怯，神魂不安，夜不能寐（C对）。阴虚火旺，心肾不交，君相火旺，虚火扰心（D对）。气郁痰结，阻闭神明，可导致癫狂（E错，为本题正确答案）。